下列二氢吡啶类钙离子拮抗剂中2，6位取代基不同的药物是
A. 尼莫地平
B. 尼群地平
C. 氨氯地平
D. 硝苯地平
E. 硝苯啶

正确答案：C。氨氯地平